以下有关HCV的相关叙述中，不正确的一项是
A. HCV对外界抵抗力非常强
B. 基因组为单股正链RNA
C. 对氯仿、乙醚等脂溶剂敏感
D. 煮沸、10%甲醛浸泡或紫外线照射可灭活
E. 过去曾称作非甲非乙型肝炎病毒

正确答案：A。HCV对外界抵抗力非常强

解析：丙型肝炎病毒（HCV）属于黄病毒科丙型肝炎病毒属，过去曾称作非甲非乙型肝炎病毒。HCV对外界抵抗力不强，对氯仿、乙醚等脂溶剂敏感，煮沸、10%甲醛浸泡或紫外线照射均可灭活。掌握“丙型、丁型、戊型肝炎病毒”知识点。